应当按照《药品不良反应报告和监测管理办法》规定报告所发现的药品不良反应的是
A. 中药生产基地、药品研发基地、疾控中心
B. 乡镇卫生院、药品经营企业、药品检验机构
C. 药品生产企业、药品经营企业、药物临床前研究基地
D. 药品批发企业、医疗门诊部、新药研发机构
E. 医疗机构、药品经营企业、药品生产企业

正确答案：E。医疗机构、药品经营企业、药品生产企业

解析：本题考查药品不良反应报告与处置。应当按照《药品不良反应报告和监测管理办法》规定报告所发现的药品不良反应的是医疗机构、药品经营企业、药品生产企业（E对）。药品生产、经营企业和医疗机构获知或者发现可能与用药有关的不良反应，应当通过国家药品不良反应监测信息网络报告；不具备在线报告条件的，应当通过纸质报表报所在地药品不良反应监测机构，由所在地药品不良反应监测机构代为在线报告。